细菌的转导和溶原性转换的共同特点是
A. 不需供体菌
B. 不需受体菌
C. 需质粒
D. 需噬菌体
E. 供体菌与受体菌直接接触

正确答案：D。需噬菌体

解析：转导指由噬菌体介导，从供体菌向同种的受体菌转移遗传物质（DNA片段），使受体菌获得新的遗传性状。溶原性转换指温和噬菌体感染细菌（称为溶原菌）后，以前噬菌体形式与溶原菌的染色体整合，导致溶原菌的基因型改变及获得新的遗传特征。掌握“细菌遗传变异的物质基础及机制”知识点。